种类繁多，长短粗细差异较大，有链杆状、分枝状、栅栏状等多种排列形式
A. 球菌
B. 杆菌
C. 真菌
D. 螺形菌
E. 放线菌

正确答案：B。杆菌

解析：杆菌：种类繁多，长短粗细差异较大，有杆状、球杆状、棒状及梭状等，并有链杆状、分枝状、栅栏状等多种排列形式，直径0.3～1.0μm，长0.6～10μm不等。掌握“细菌的大小、形态和基本结构”知识点。